哌唑嗪的不良反应可表现为
A. 低血钾
B. 消化性溃疡
C. 水钠潴留
D. 粒细胞减少
E. 体位性低血压

正确答案：E。体位性低血压

解析：哌唑嗪为选择性α1受体阻断剂，对动静脉血管上的α1受体有较高的选择性阻断的作用，可减少外周阻力血管、扩张血管、降低血压，可引起体位性低血压（直立性低血压）（E对）。低血钾（A错）为排钾利尿剂最常见的不良反应。消化性溃疡（B错）为非甾体抗炎药最常见的不良反应。水钠潴留（C错）为β阻滞剂的不良反应。粒细胞减少（D错）为抗肿瘤药物的不良反应。